肺炎支原体肺炎最常见的胸部X线表现是
A. 早期为下叶间质性改变，肺实变后为边缘模糊的斑片状阴影
B. 肺叶和小叶实变，叶间隙呈孤形下坠，多发性蜂窝状脓肿形成
C. 肺叶或肺段实变，呈多发性周围性肺浸润，可伴气囊肿
D. 呈叶段分布的炎性实变阴影，在实变阴影中可见支气管气道征
E. 病变多在肺上部，里大片浓密阴影，密度不均，历久不消散，可形成

正确答案：A。早期为下叶间质性改变，肺实变后为边缘模糊的斑片状阴影

解析：肺炎支原体肺炎为间质性肺炎，最常见的胸部X线表现是早期为下叶间质性支气管炎，肺实变后显示肺部多种形态的浸润影（A对）。肺叶和小叶实变，叶间隙呈孤形下坠，多发性蜂窝状脓肿形成（B错）是肺炎克雷伯杆菌常见X线征象。肺叶或肺段实变，呈多发性周围性肺浸润，可伴气囊腔（C错）是金黄色葡萄球菌常见X线征象。呈叶段分布的炎性实变阴影，在实变阴影中可见支气管气道征（D错）是肺炎链球菌肺炎常见X线征象。病变多在肺上部，大片浓密阴影，密度不均，历久不消散，可形成空洞（E错）是继发型肺结核的X线表现。